可复性牙髓炎的诊断要点是
A. 主诉对温度刺激一过性敏感
B. 无自发痛史
C. 有能引起牙髓病变的牙体病损或牙周组织损害
D. 对牙髓活力测验的反应域值降低
E. 以上均是

正确答案：E。以上均是

解析：本题考查可复性牙髓炎的诊断要点。可复性牙髓炎指牙髓呈充血状态，病变轻微，若能彻底去除作用于患牙上的病源刺激因素，同时给予患牙适当的治疗，患牙的牙髓是可以恢复到原有状态的。可复性牙髓炎的诊断要点：主诉对温度刺激一过性敏感（A对），尚未发展呈不可复性牙髓炎，无自发痛（B对）。有能引起牙髓病变的牙体病损或牙周组织损害（C对），患牙常见有接近髓腔的牙体硬组织病损，如深龋、深楔状缺损，或可查及患牙有深牙周袋。患牙对冷热的反应阈值降低（D对），表现为一过性敏感。（ABCD均对，故E为本题的正确答案）。